具有降压作用的利尿药物是
A. 卡托普利
B. 普萘洛尔
C. 硝苯地平
D. 氢氯噻嗪
E. 哌唑嗪

正确答案：D。氢氯噻嗪

解析：氢氯噻嗪（D对）是噻嗪类利尿剂，其通过增强NaCl和水的排出，产生温和和持久的利尿作用，也可通过利尿、减少血容量而降压，长期应用可扩张外周血管而产生降压作用。卡托普利（A错）是具有降压作用的血管紧张素转换酶抑制剂，具有降压作用，但没有利尿的作用。普萘洛尔（B错）是β受体阻滞剂，有降压的作用，但没有利尿的作用。硝苯地平（C错）是具有降压作用的钙通道阻滞剂，但没有利尿的作用。哌唑嗪（E错）是具有降压作用的α受体阻断药，但没有利尿的作用。